丹参的醌类成分中，属于对醌类化合物的是
A. 丹参醌ⅡA
B. 隐丹参醌
C. 丹参醌Ⅰ
D. 丹参新醌甲
E. 丹参酸甲酯

正确答案：D。丹参新醌甲

解析：本题考查的是丹参中醌类化合物的分类。丹参的醌类成分中，属于对醌类化合物的是丹参新醌甲（D对）。天然菲醌类衍生物包括邻醌及对醌两种类型。如从中药丹参根中提取得到多种菲醌衍生物，其中丹参醌Ⅰ（C错）、丹参醌ⅡA（A错）、丹参醌ⅡB、隐丹参醌（B错）、丹参酸甲酯（E错）、羟基丹参醌ⅡA等为邻醌类衍生物，而丹参新醌甲、丹参新醌乙、丹参新醌丙则为醌类化合物。